能透过细胞膜并与细胞内受体结合的激素是
A. 胰高血糖素
B. 胰岛素
C. 盐皮质激素
D. 肾上腺素
E. 促性腺激素

正确答案：C。盐皮质激素